临床上表现为腭中线前部的肿胀，有时可伴疼痛或瘘管形成，为以下哪项疾病最常见
A. 鼻腭管（切牙管）囊肿
B. 鼻牙槽囊肿
C. 龈乳头囊肿
D. 根尖周囊肿
E. 鼻唇囊肿

正确答案：A。鼻腭管（切牙管）囊肿

解析：鼻腭管（切牙管）囊肿临床上最常见的表现为腭中线前部的肿胀，有时可伴疼痛或瘘管形成。掌握“鼻腭管囊肿及鼻唇囊肿”知识点。